可摘局部义齿固位体必须具备的条件不包括
A. 无异物感
B. 对基牙不产生矫治性移位
C. 不易积存食物
D. 避免口内使用不同种类的金属
E. 取戴时，对基牙无侧方压力

正确答案：A。无异物感

解析：本题考查可摘局部义齿固位体必须具备的条件。可摘义齿体积大，部件多，有异物感是其主要缺点，应在设计合理的前提下做到小而不弱，薄而不断，尽可能做得小巧，以减轻异物感，但是异物感是不可避免的（A错，为本题的正确答案），这不是可摘局部义齿应具备的条件。可摘局部义齿固位体必须具备的条件包括：（1）对基牙不应产生矫治性移位（B对），否则基牙会松动。（2）不易积存食物（C对），否则余留牙易产生牙龈炎，继发龋等。（3）避免口内使用不同种类的金属（D对），以免产生电流作用。（4）取戴时，对基牙无侧方压力（E对），否则会损伤基牙。